患者，女，46岁。神思恍惚，梦魂颠倒，心悸易惊，善悲欲哭，肢体困乏，饮食减少，舌质淡，脉细无力。其冶法是
A. 健脾养心，益气安神
B. 健脾养心，益气活血
C. 健脾养心，化痰解郁
D. 益气养血，化痰祛瘀
E. 益气和胃，养心安神

正确答案：A。健脾养心，益气安神

解析：心气虚弱而致心神不安，故见梦魂颠倒，心悸易惊；脾气不足，运化无权故见肢体困乏，饮食减少；舌质淡，脉细无力均为心脾两虚之侯。因此治疗上应当心脾双补兼以安神（A对）。健脾养心，益气活血（B错）用于治疗气虚血瘀证。健脾养心，化痰解郁（C错）可以治疗气郁痰凝证。益气养血，化痰祛瘀（D错）用于治疗痰瘀互结证。益气和胃，养心安神（E错）用于治疗胆胃不和证。